Ⅲ度扁桃体肿大的定义为
A. 肿大的扁桃体不超过咽腭弓
B. 肿大的扁桃体不超过悬壅垂
C. 肿大的扁桃体不超过咽后壁中线
D. 肿大的扁桃体超过咽腭弓但不到咽后壁中线
E. 肿大的扁桃体达到或超过咽后壁中线

正确答案：E。肿大的扁桃体达到或超过咽后壁中线

解析：扁桃体肿大分度：Ⅰ度肿大的扁桃体不超过咽腭弓（A错）；Ⅱ度肿大的扁桃体超过咽腭弓（D错），介于Ⅰ度和Ⅲ度之间；Ⅲ度肿大的扁桃体达到或超过咽后壁中线（E对）。